从公共卫生伦理的角度，为因防治雾霾而对产生工业污染的企业采取限制政策的正当性进行伦理辩护的理论是
A. 福利主义
B. 境遇主义
C. 自由主义
D. 功利主义
E. 社群主义

正确答案：E。社群主义

解析：为因防治雾霾而对产生工业污染的企业采取限制政策，体现了在面对个人权利与公共善的冲突时，限制个人权利以维护公共卫生，对此行为的正当性进行伦理辩护的理论是社群主义（E对）。